临床上选用的抗乙型病毒性肝炎药物有
A. 拉米夫定
B. α-干扰素
C. 阿德福韦酯
D. 阿昔洛韦
E. 恩替卡韦

正确答案：A、B、C、E。拉米夫定；α-干扰素；阿德福韦酯；恩替卡韦

解析：本题考查抗乙型病毒性肝炎的药物。临床上抗乙型病毒性肝炎的药物有：（1）α-干扰素（B对）；（2）核苷酸类似物：拉米夫定（A对）、阿德福韦（C对）、恩替卡韦（E对）、替比夫定和替诺福韦等。阿昔洛韦（D错）为治疗带状疱疹的药物。